血管神经性水肿发生在哪个部位最危险
A. 唇部
B. 舌部
C. 腭部
D. 会厌处
E. 眼睑

正确答案：D。会厌处

解析：本题考查血管神经性水肿。血管神经性水肿为一种急性局部反应型的黏膜皮肤水肿，病变好发于头面部疏松结缔组织处，如唇部、舌部、眼睑、耳垂、软腭、会厌等处。发生在会厌处（D对）则可因肿胀阻塞气道而影响呼吸，甚至导致窒息，可致死亡，是最危险的。发生在唇部（A错）、舌部（B错）、腭部（C错）、眼睑（E错）的血管神经性水肿以肿胀为主要表现，除了有发紧膨胀感，并无其他明显症状，肿胀会在数小时或数天后消退，不留痕迹。